下列各项中，可以与附子同用的药物是
A. 白及
B. 白蔹
C. 贝母
D. 瓜蒌
E. 细辛

正确答案：E。细辛

解析：乌头（包括川乌、草乌、附子）反浙贝母、川贝母（C错）、瓜蒌（D错）、天花粉、半夏、白及（A错）、白蔹（B错）；甘草反海藻、京大戟、红大戟、甘遂、芫花；藜芦反人参、西洋参、党参、丹参、玄参、北沙参、南沙参、苦参、细辛（E对）、白芍、赤芍。